破伤风病人典型的症状是肌紧张性收缩的基础上，发生阵发性肌肉强烈痉挛，通常最先受影响的肌群是
A. 面部表情肌
B. 咀嚼肌
C. 胸部肌群
D. 背部肌群
E. 四肢肌

正确答案：B。咀嚼肌

解析：破伤风梭菌在缺氧环境中迅速繁殖并产生大量外毒素，主要是痉挛毒素，毒素吸收至脊髓、脑干处，与联络神经细胞的突触结合，抑制突触释放抑制性神经递质，运动神经元因失去中枢抑制，兴奋性增强，导致肌痉挛。但因为全身肌肉对毒素的敏感性不同，由高到低为咀嚼肌（B对）、面部表情肌（A错）、颈项（C错）、背（D错）、腹、四肢肌（E错），最后为膈肌，因此肌肉痉挛也依照此顺序出现。